甲型肝炎具有传染性的时间是
A. 发病前2周至发病后2～3周
B. 发病前2周
C. 发病后2周
D. 发病时
E. 以上都不是

正确答案：A。发病前2周至发病后2～3周

解析：本题考查甲型肝炎具有传染性的时间。甲型肝炎具有传染性的时间是发病前2周至发病后2～3周（A对BCDE错）。